常用蜂蜜作辅料炮制的药物是
A. 当归
B. 白芍
C. 巴戟天
D. 丹参
E. 百部

正确答案：E。百部

解析：本题考查的是炮制常用辅料与作用。常用蜂蜜作辅料炮制的药物是百部（E对）。常用蜂蜜炮制的药物有甘草、麻黄、紫菀、百部、马兜铃、白前、枇杷叶、款冬花、百合、桂枝等。酒多用作炙、蒸、煮的辅料，常用酒制的药物有黄芩、黄连、大黄、白芍（B错）、续断、当归（A错）、丹参（D错）、川芎、白花蛇、乌梢蛇等。常以盐水炮制的药物有知母、黄柏、杜仲、巴戟天（C错）、小茴香、橘核、车前子、砂仁、菟丝子、补骨脂、益智仁、泽泻、沙苑子等。